男，35岁，外伤后腰痛伴右下肢麻木1周。查体：腰部活动受限，右小腿外侧感觉减退，疑有腰椎间盘突出症，最有诊断价值的检查方法是
A. X线片
B. 透视
C. CT
D. 核素骨扫描
E. 肌电图

正确答案：C。CT

解析：对腰椎间盘突出症最有诊断价值的检查方法是MRI，能清楚地显示出人体解剖结构的图像，全面观察各椎间盘退变情况，还可以了解髓核突出的程度和位置。其次为CT，能更好地显示脊柱骨性结构的细节。所给选项中无MRI，故本题最佳答案为CT（C对）。X线片（P733）（A错）不能直接反映是否存在椎间盘突出，仅可根据脊柱所发生的变化间接判断，通常只作为常规检查，对本病诊断意义不大。透视（B错）主要用于胃肠道疾病的诊断，对腰间盘突出的诊断价值不大。核素骨扫描（D错）主要用于恶性肿瘤骨转移的诊断。肌电图（P733）（E错）可以协助腰椎间盘突出的诊断，但其诊断价值不及MRI和CT。